下列检查结果中最能反映慢性肾炎患者肾实质严重损害的是
A. 尿蛋白明显增多
B. 尿中白细胞明显增多
C. 尿中红细胞明显增多
D. 尿中出现管型
E. 尿比重固定于1.010左右

正确答案：E。尿比重固定于1.010左右

解析：慢性肾炎患者主要表现为蛋白尿、血尿、水肿和高血压，当肾实质严重损害时可出现尿蛋白明显增多（A错）、尿中红细胞明显增多（C错）、尿中出现管型（D错）、尿比重严重降低、合并感染还可出现尿中白细胞明显增多（B错），但尿比重固定于1.010左右（E对）是其中最能反映慢性肾炎患者肾实质严重损害的指标。